蜂蜜久贮或遇冷析出的白色颗粒状结晶，其成分是
A. 蔗糖
B. 果糖
C. 菊糖
D. 鼠李糖
E. 葡萄糖

正确答案：E。葡萄糖

解析：本题考查的是蜂蜜的成分。蜂蜜久贮或遇冷析出的白色颗粒状结晶，其成分是葡萄糖（E对）。蜂蜜【成分】主含葡萄糖及果糖约70%，两者含量相近，“油性大”、质量好的蜂蜜果糖含量较高。蜂蜜【性状鉴别】药材为半透明、带光泽、浓稠的液体，白色至淡黄色或橘黄色至黄褐色，放久或遇冷渐有白色颗粒状结晶析出。